药品标签上应注明“用前摇匀”的制剂是
A. 酒剂
B. 口服混悬剂
C. 口服乳剂
D. 糖浆剂
E. 口服液

正确答案：B。口服混悬剂

解析：本题考查的是口服混悬液的质量要求。药品标签上应注明“用前摇匀”的制剂是口服混悬剂（B对）。口服混悬剂的应分散均匀，放置后若有沉淀物，经振摇应易再分散。口服混悬剂在标签上应注明“用前摇匀”。配置后的酒剂（A错）需静置澄清，在贮存期间允许有少量摇之易散的沉淀。口服乳剂（C错）可能会出现相分离现象，但经振摇应易再分散。糖浆剂（D错）中允许有少量摇之易散的沉淀，用前应摇匀服用。但是中药糖浆剂易产生沉淀，沉淀过多不符合糖浆剂的质量要求，不宜服用。口服液（E错）是单剂量灌装的合剂。合剂应澄清，在贮存期间允许有少量摇之易散的沉淀。